男，72岁。咳嗽、咳痰30年，加重伴气短10天。查体：神志清楚，口唇发绀，桶状胸，双肺闻及少许干湿性啰音。胸部X线片示双肺纹理增粗紊乱。血气分析示PaO₂55mmHg，PaCO₂39mmHg。该患者发生呼衰的机制是
A. 肺内分流
B. 弥散功能障碍
C. 肺通气不足
D. 氧耗量增加
E. 通气/血流比例失调

正确答案：E。通气/血流比例失调

解析：患者为老年男性，咳嗽、咳痰30年（为慢阻肺的标志性症状），桶状胸，双肺闻及少许干湿性啰音，胸部X线片示双肺纹理增粗絮乱，考虑诊断为慢性阻塞性肺疾病（COPD）。血气分析示PaO₂ 55mmHg（正常为大于60mmHg），PaCO₂ 39mmHg（正常为35～45mmHg），提示为COPD伴发Ⅰ型呼吸衰竭，主要机制是通气/血流比例失调（E对B错）。肺内分流（A错）主要是急性呼吸窘迫综合征造成顽固性低氧的机制。肺通气不足（C错）是Ⅱ型呼衰的机制。发热、寒战、呼吸困难均增加耗氧量，使其肺泡氧分压下降，正常人可通过增加通气量来防止缺氧的发生，若耗氧量增加的患者同时伴有通气功能障碍，则会出现严重的低氧血症，该患者PaO₂ 55mmHg（正常为60mmHg）为轻度低氧血症，故不考虑耗氧量增加（D错）。可以记忆：除了COPD一型呼衰为通气血流比例失调，其余均为一换二通